男，45岁。双上睑下垂伴四肢无力1年，晨轻暮重。治疗过程中出现呼吸困难、多汗、流涎、瞳孔缩小，最可能的原因是
A. 5-HT系统亢进
B. 肾上腺素能系统亢进
C. 胆碱能系统抑制
D. 肾上腺素能系统抑制
E. 胆碱能系统亢进

正确答案：E。胆碱能系统亢进

解析：中年男性患者，双上睑下垂伴四肢无力1年（重症肌无力的表现），晨轻暮重。治疗过程中出现呼吸困难（副交感神经M受体兴奋）、多汗（交感神经M受体兴奋）、流涎、瞳孔缩小，表现为毒蕈碱样症状，又称M样症状。为胆碱能系统亢进（E对C错），与5-HT系统（A错）无关，肾上腺素能系统亢进（BD错）表现为库欣综合征和醛固酮增多症。